油管中含金黄色分泌物的中药材是
A. 防风
B. 川芎
C. 当归
D. 白芷
E. 柴胡

正确答案：A。防风